根据《麻醉药品和精神药品品种目录（2009年版）》属于第二类精神药品的是
A. γ-羟丁酸
B. 西地那非
C. 麦角酸
D. 吗啡阿托品注射液
E. 阿普唑仑

正确答案：E。阿普唑仑

解析：本题考察特殊药品管理。根据《麻醉药品和精神药品品种目录（2009年版）》属于第二类精神药品的是阿普唑仑（E对）。